以下为制订或修订大气卫生标准的原则，除了
A. 对机体不应引起急、慢性中毒，包括潜在的远期危害
B. 对主观感觉无不良影响
C. 对健康无间接危害
D. 选择最敏感的指标作为确定基准值的依据
E. 基准值是制订卫生标准的唯一依据

正确答案：E。基准值是制订卫生标准的唯一依据

解析：本题考查大气卫生标准的制订原则。大气卫生标准的制订原则包括：1.对机体不应引起急、慢性中毒，包括潜在的远期危害（A对）；2.对主观感觉无不良影响（B对）；3.对人体健康无间接影响（C对）；4.选择最敏感的指标作为确定基准值的依据（D对）；5.经济合理和技术可行。制订卫生标准以基准值为科学依据，但基准值并不是制订卫生标准的唯一依据（E错，为本题正确答案），制订卫生标准还要考虑社会、经济、技术条件等因素。